下列关于医学心理学的表述不正确的是
A. 是一门交叉学科
B. 是医学的分支学科
C. 以维护和促进人类整体健康为目的
D. 以人作为主要研究和服务对象
E. 研究医学领域中的心理学问题

正确答案：B。是医学的分支学科